属减毒的配伍药组是
A. 麻黄配桂枝
B. 肉桂配黄连
C. 生姜配半夏
D. 甘草配甘遂
E. 乌头配白及

正确答案：C。生姜配半夏

解析：本题考查的是生姜与半夏配伍的功效。属减毒的配伍药组是生姜配半夏（C对）。生姜配半夏，可解半夏毒。生姜：【主治病证】（1）风寒表证。（2）胃寒呕吐。（3）风寒客肺之咳嗽。（4）解鱼蟹、半夏及天南星毒。麻黄配桂枝（A错）：麻黄辛温，功善宣肺发汗解表；桂枝辛甘温，功善发汗解表、助阳通脉。两药相配，发汗解表力强，善治风寒表实无汗。甘草与甘遂（D错）、乌头与白及（E错）属于相反，不宜同用，同用能产生或增强毒害反应。肉桂配黄连（B错）的功效，2022年考试指南未明确说明。